在月经周期中。引起排卵主要的直接作用激素是
A. 卵泡刺激素
B. 黄体生成素
C. 孕激素
D. 雌激素
E. hCG

正确答案：C。孕激素